男，12岁，一周前右膝肿胀，高热，呕吐，呈脓毒症样发作，浮髌试验阳性。下列诊断正确的是
A. 急性骨髓炎
B. 软骨肉瘤
C. 骨性结核
D. 风湿病
E. 化脓性关节炎

正确答案：A。急性骨髓炎

解析：患者右膝肿胀，高热呕吐，呈脓毒样发作，诊断为急性骨髓炎（A对）。外科，骨与关节化脓性感染，第一节，提到，急性血源性骨髓炎，如果病灶临近关节，可有反应性关节积液。